《医疗机构管理条例、医疗机构管理条例实施细则、麻醉药品管理法》、《医疗事故处理条例》等规范性文件，在我国卫生法律体系中，属于
A. 卫生行政法规
B. 卫生专门法律
C. 卫生法律
D. 基本法律
E. 卫生技术法规

正确答案：A。卫生行政法规

解析：《医疗机构管理条例、医疗机构管理条例实施细则、麻醉药品管理法》、《医疗事故处理条例》等规范性文件，在我国卫生法律体系中，属于卫生行政法规（A对）。卫生法律包括：传染病防治法、国境卫生检疫法、职业病防治法、精神卫生法、食品安全法、药品管理法、执业医师法、母婴保健法、献血法、人口与计划生育法和红十字会法（C错）。基本法律包括：宪法、刑法、民法通则、刑事诉讼法、民事诉讼法、行政诉讼法（D错）。我国不存在卫生专门法律（B错）和卫生技术法规（E错）。